石膏与知母均有的功效是
A. 清热泻火
B. 滋阴生津
C. 润燥滑肠
D. 消肿止痛
E. 利尿消肿

正确答案：A。清热泻火

解析：本题考查的是石膏与知母的功效。石膏与知母均有的功效是清热泻火的（A对）。石膏：【功效】生用：清热泻火，除烦止渴；煅用：收湿敛疮，生肌止血。知母：【功效】清热泻火，滋阴润燥。知母上清肺热而泻火，中清胃热而除烦渴，下滋肾阴而润燥滑肠（C错）、退虚热。生地：【功效】清热凉血，养阴生津（B错），润肠。栀子：【功效】泻火除烦，清热利尿，凉血解毒，消肿止痛（DE错）。